按分散系统分类，炉甘石洗剂属液体制剂的类型是
A. 溶胶剂
B. 高分子溶液剂
C. 乳剂
D. 混悬剂
E. 低分子溶液剂

正确答案：D。混悬剂

解析：本题考查的是混悬剂。按分散系统分类，炉甘石洗剂属液体制剂的类型是混悬剂（D对）。混悬剂系指难溶性固体药物以微粒状态分散于分散介质中形成的非均相的液体制剂，也包括干混悬剂。为了增加混悬剂的物理稳定性，在制备时需加入能使混悬剂稳定的附加剂，包括润湿剂、助悬剂、絮凝剂和反絮凝剂等。炉甘石洗剂：【注解】炉甘石、氧化锌为药物，甘油为润湿剂，羧甲基纤维素钠为助悬剂。制备时将炉甘石和氧化锌粉末先加甘油研成细糊，再与羧甲基纤维素钠水溶液混合，使粉末周围形成水的保护膜，以阻碍颗粒的聚集，振摇时易摇匀。本品外用，用前摇匀。溶胶剂（A错）系指固体药物以多分子聚集体分散于水中形成的非均相的液体制剂，亦称疏水胶体溶液。高分子溶液剂（B错）系指高分子化合物溶解于溶剂中制成的均匀分散的液体制剂，属于热力学稳定体系。乳剂（C错）系指两种互不相溶的液体，经乳化制成的一种液体以液滴状态分散于另一相液体中形成的非均相分散体系的液体制剂。低分子溶液剂（E错）：系指小分子药物以分子或离子状态分散在溶剂中形成的均相液体制剂。